肾病综合征常见于
A. 微小病变
B. 毛细血管内增生性肾炎
C. 系膜增生性肾炎
D. 新月体肾炎
E. 系膜毛细血管性肾炎

正确答案：C。系膜增生性肾炎

解析：微小病变型肾病（A错）、系膜增生性肾炎、系膜毛细血管性肾炎（E错）均为肾病综合症常见病因。但系膜增生性肾炎（C对）在我国发病率高，约占原发性肾病综合征的30%，发病率在五种常见病因中最高，故C为最佳答案。毛细血管内增生性肾炎（B错）为急性肾炎病理类型。新月体性肾小球肾炎（D错）为急进性肾小球肾炎病理类型。